关于老年人用药安全的说法正确的有
A. 尽量不要自行加用非处方药及保健品
B. 用药过程中，根据自身经验增加剂量或给药次数，会有利于提高疗效
C. 除了注意药物间相互作用，也要注意食物对药物的影响
D. 用药过程中，应关注药品不良反应，发现问题及时就医
E. 就诊或用药咨询时，应携带所用药品，或提供药品的名称、剂量等信息

正确答案：A、C、D、E。尽量不要自行加用非处方药及保健品；除了注意药物间相互作用，也要注意食物对药物的影响；用药过程中，应关注药品不良反应，发现问题及时就医；就诊或用药咨询时，应携带所用药品，或提供药品的名称、剂量等信息

解析：本题考查老年人用药安全。老年人机体内环境改变，肝肾功能下降，尽量不要自行加用非处方药及保健品（A对）。除了注意药物间相互作用，也要注意食物对药物的影响（C对）。用药过程中，应关注药品不良反应，发现问题及时就医（D对）。就诊或用药咨询时，应携带所用药品，或提供药品的名称、剂量等信息（E对）。用药过程中，根据自身经验增加剂量或给药次数，不利于提高疗效（B错）。